乡村医生李某熟悉中草药的栽培技术，并自种、自采、自用中草药。李某的下列做法，正确的是
A. 将自种的中草药在其所在的村卫生所使用
B. 自种、自采、自用需特殊加工炮制的中草药
C. 将自种的中草药加工成中药制剂
D. 种植中药材洋金花

正确答案：A。将自种的中草药在其所在的村卫生所使用

解析：本题考查的是中药材自种、自采、自用的管理规定。乡村医生李某熟悉中草药的栽培技术，并自种、自采、自用中草药。李某的下列做法，正确的是将自种的中草药在其所在的村卫生所使用（A对）。中药材自种、自采、自用的管理规定：自种、自采、自用中草药是指乡村中医药技术人员自己种植、采收、使用，不需特殊加工炮制的植物中草药（B错）。《中共中央国务院关于进一步加强农村卫生工作的决定》提出了在规范农村中医药管理和服务的基础上，允许乡村中医药技术人员自种、自采、自用中草药的要求。《中医药法》规定，在村医疗机构执业的中医医师、具备中药材知识和识别能力的乡村医生，按照国家有关规定可以自种、自采地产中药材并在其执业活动中使用。乡村中医药技术人员不得自种自采自用下列中草药：①国家规定需特殊管理的医疗用毒性中草药（D错）；②国家规定需特殊管理的麻醉药品原植物；③国家规定需特殊管理的濒稀野生植物药材。根据当地实际工作需要，乡村中医药技术人员自种自采自用的中草药，只限于其所在的村医疗机构内使用，不得上市流通，不得加工成中药制剂（C错）。自种自采自用的中草药应当保证药材质量，不得使用变质、被污染等影响人体安全、药效的药材。对有毒副反应的中草药，乡村中医药技术人员应严格掌握其用法用量，并熟悉其中毒的预防和救治。发现可能与用药有关的毒副反应，应按规定及时向当地主管部门报告。乡村民族医药技术人员自种自采自用民族草药的管理参照上述条款执行。